石膏的主治病证有
A. 肺热咳喘
B. 心火上炎
C. 胃火牙痛
D. 湿热泻痢
E. 温病气分高热

正确答案：A、C、E。肺热咳喘；胃火牙痛；温病气分高热

解析：本题考查的是石膏的主治病证。石膏的主治病证有肺热咳喘（A对）、胃火牙痛（C对）与温病气分高热（E对）。石膏：【主治病证】（1）温病气分高热。（2）肺热咳喘。（3）胃火上炎所致的头痛、牙龈肿痛、口舌生疮。（4）疮疡不敛，湿疹，水火烫伤，外伤出血。竹叶：【主治病证】（1）热病烦渴，心火上炎（B错）之口舌生疮。（2）热淋，小便不利。（3）热入心包之神昏谵语。黄柏：【主治病证】（1）湿热下注之带下、淋浊、脚气、足膝红肿。（2）湿热黄疸，湿热泻痢（D错），湿疹，湿疮。（3）热毒疮肿，口舌生疮，血热出血。（4）阴虚之盗汗遗精，骨蒸潮热。